在氯化消毒法中，哪一种是杀菌能力最强的物质
A. 漂白粉加入水中后水解成的次氯酸（HOCl）
B. 次氯酸在水中电离反应生成的次氯酸根（OCl⁻）
C. 漂白粉消毒时生成的氢氧化钙
D. 漂白粉加入水中后水解成的氯离子（Cl⁻）
E. 以上都不是

正确答案：A。漂白粉加入水中后水解成的次氯酸（HOCl）

解析：本题考查氯化消毒法。在氯化消毒法中，漂白粉加入水中后水解成的次氯酸（HOCl）（A对BCDE错）是杀菌能力最强的物质。因为次氯酸体积小，电荷中性，易于穿过细胞壁；同时，它又是一种强氧化剂，能损害细胞膜，使蛋白质、RNA和DNA等物质释出，并影响多种酶系统，从而使细菌死亡。